社会经历及习惯、嗜好应记入
A. 现病史
B. 既往史
C. 个人史
D. 月经及婚育史
E. 家族史

正确答案：C。个人史

解析：本题考查口外病史记录。个人史（C对）：记录出生地及长期居留地，生活习惯及有无烟、酒、药物等嗜好，职业与工作条件及有无工业毒物、粉尘、放射性物质接触史，有无冶游史。